土壤中蛋白质和其他含氮化合物，在需氧和厌氧条件下分解而产生氨的过程为
A. 硫化作用
B. 腐殖质化作用
C. 氨化作用
D. 亚硝化作用
E. 硝化作用

正确答案：C。氨化作用

解析：本题考查氨化作用。土壤中的有机物，包括蛋白质和其它含氮化合物，在受放射性碳和微生物的作用下，可以在有氧条件和厌氧条件下分解而产生氨，这一过程在土壤中叫做氨化作用（C对ABDE错）。